《关于城镇医药卫生体制改革的指导意见》指出，社区卫生服务组织、门诊部及个体诊所只可经销由省级卫生、药品监督部门审定的
A. 特殊管理的药品
B. 常用药品
C. 急救药品
D. 常用和急救药品
E. 处方药

正确答案：D。常用和急救药品

解析：本题考查药品使用管理。《关于城镇医药卫生体制改革的指导意见》指出，社区卫生服务组织、门诊部及个体诊所只可经销由省级卫生、药品监督部门审定的常用药品和急救药品（D对）。